在一个研讨班上，学员对假劣药情形、使用法律和法律责任展开了讨论。讨论的情形主要包括五个，一是某药厂未经批准擅自委托生产药品；二是某药品未标明有效期；三是直接接触药品的包装材料未经批准；四是在生物制品中擅自添加着色剂；五是生物制剂中擅自添加防腐剂。上述信息中所指的几种情形，应按假药或者假药论处的是
A. 某药厂未经批准擅自委托生产药品
B. 某药品未标明有效期
C. 直接接触药品的包装材料未经批准
D. 在生物制品中擅自添加着色剂
E. 生物制剂中擅自添加防腐剂

正确答案：A。某药厂未经批准擅自委托生产药品

解析：《药品管理法》规定，禁止生产、销售假药。有下列情形之一的，为假药：①药品所含成份与国家药品标准规定的成份不符的；②以非药品冒充药品或者以他种药品冒充此种药品的。有下列情形之一的药品，按假药论处:①国务院药品监督管理部门规定禁止使用的；②依照本法必须批准而未经批准生产、进口，或者依照本法必须检验而未经检验即销售的；③变质的；④被污染的；⑤使用依照本法必须取得批准文号而未取得批准文号的原料药生产的；⑥所标明的适应症或者功能主治超出规定范围的。掌握“药品管理及法律责任”知识点。